男，30岁。右下腹可复性包块2年。查体：右侧腹股沟区呈梨形隆起，平卧回纳后压住腹股沟深环不再复出，无压痛。以下最可能的情况是
A. 部分膀胱壁在疝囊内
B. 精索在疝囊前外侧
C. 疝囊颈位于腹壁下动脉外侧
D. 盲肠是疝囊壁的一部分
E. 直疝三角部分腹壁薄弱

正确答案：C。疝囊颈位于腹壁下动脉外侧

解析：青年患者，右下腹可复性包块，右侧腹股沟区呈梨形隆起，平卧回纳后压住腹股沟深环不再复出，因此为斜疝。斜疝：精索在疝囊后方（B错）、疝囊颈位于腹壁下动脉外侧（C对）。盲肠是疝囊壁的一部分（D错）称为滑动疝，也属难复性疝（P307）。直疝三角部分腹壁薄弱（E错）见于直疝。